湖泊、水库水质监测的对照点应设在
A. 上游来水入口处
B. 用水点周围
C. 污染源排入口上游
D. 未受污染的岸边
E. 湖水、库水出口处

正确答案：D。未受污染的岸边

解析：本题考查湖泊、水库水质监测的对照点设置。湖泊、水库的监测应结合水体自身特点，可按不同水区设置监测断面，如进水区、出水区、深水区、浅水区、湖心区、污染源废水排入区等设置采样点，同时以远离污染的清洁区（D对ABCE错）水样作对照。